下列各项，不属肺生理特性的是
A. 肺为华盖
B. 肺为娇脏
C. 肺气宣发
D. 肺气肃降
E. 肺朝百脉

正确答案：E。肺朝百脉

解析：该题考查肺的生理特性和生理机能以及二者区别，理解记忆即可。肺的生理机能是主气司呼吸、主行水、朝百脉、主治节（E错，为本题正确答案）。肺生理特性是肺为华盖（A对）、肺为娇脏（B对）、肺气宣降（CD对）。